牙体修复是一项生物性治疗技术，备洞时，洞侧壁的釉质壁必须与釉柱方向
A. 垂直
B. 平行
C. 成45°角
D. 成60°角
E. 成90°角

正确答案：B。平行

解析：本题考查洞侧壁的釉质壁与釉柱方向的关系。备洞时，应去除无基釉和避免形成无基釉，无基釉缺乏牙本质的支持，在承受咬合力时易折裂，一般情况下都应去除所有无基釉。为防止无基釉的形成，备洞时，洞侧壁应于釉柱方向一致，即平行（B对）。